下列哪一项属于伦理学的类型
A. 元伦理学
B. 描述伦理学
C. 规范伦理学
D. 美德伦理学
E. 以上说法均正确

正确答案：E。以上说法均正确

解析：伦理学的类型包括：规范伦理学、元伦理学、描述伦理学、美德伦理学。元伦理学又称分析伦理学。掌握“伦理学”知识点。